颈椎病主要体征为
A. “4”字试验阳性
B. 伸肌腱牵拉试验（Mills）阳性
C. 杜加征（Dugas）阳性
D. 直腿抬高试验（Lasegue）阳性
E. 压头试验阳性

正确答案：E。压头试验阳性

解析：颈椎病依据其对脊髓、神经、血管等重要组织的压迫，可分为神经根型、脊髓型、交感神经型和椎动脉型。其中神经根型颈椎病主要体征有压头试验阳性（Spurling征）（E对）、牵拉试验阳性（Eaton试验）；脊髓型颈椎病有Hoffmann征、髌阵挛、踝阵挛及Babinski征等病理征阳性。“4”字试验（P757）（A错）主要用于髋关节疾病的诊断；伸肌腱牵拉试验（Mills）（P719）阳性（B错）主要用于诊断肱骨外上髁炎；杜加征（Dugas）阳性（C错）主要用于诊断肩关节脱位；直腿抬高试验（Lasegue）（P733）阳性（D错）多见于腰椎间盘突出、梨状肌综合征所致的坐骨神经损伤。